下列选项不是生物转化酶的基本特征的是
A. 广泛的底物特异性
B. 生物转化酶只有结构酶
C. 生物转化酶的结构存在多态性
D. 外源化学物存在立体选择性

正确答案：B。生物转化酶只有结构酶

解析：本题考查生物转化酶的基本特征。生物转化酶的基本特征有：①有结构酶和诱导酶之分（B错，为本题正确答案）；②广泛的底物特异性（A对）：一类或一种酶可代谢几种外源化学物，而且还可代谢内源性化学物；③立体选择性（D对）：生物转化酶对某些手性外源化学物的生物转化具有立体选择性，即对一种对映体的生物转化率要快于另一对映体；④某些酶具有多态性（C对）：其结构（即氨基酸序列）和活性不同。